可在体表扣及的股骨体表标志有
A. 股骨头
B. 股骨颈
C. 大转子
D. 粗线
E. 臀肌粗隆

正确答案：C。大转子

解析：大转子是重要的体表标志，可在体表扪及（C对）。